内梅罗污染指数可用于评价
A. 土壤环境质量评价
B. 土壤环境质量和水质污染综合评价
C. 土壤环境质量和大气环境质量评价
D. 大气环境质量和水质污染综合评价
E. 噪声环境质量评价

正确答案：B。土壤环境质量和水质污染综合评价

解析：本题考查内梅罗污染指数。内梅罗污染指数可用于土壤环境质量评价和水质污染综合评价（B对ACDE错）。